下列有关氧化磷酸化的叙述，错误的是
A. 物质在氧化时伴有ADP磷酸化生成ATP的过程
B. 氧化磷酸化过程存在于线粒体内
C. P/O可以确定ATP的生成数
D. 氧化磷酸化过程有两条呼吸链
E. 电子分别经两种呼吸链传递至氧，均产生3分子ATP

正确答案：E。电子分别经两种呼吸链传递至氧，均产生3分子ATP

解析：氧化磷酸化过程存在于线粒体内（B对），物质在氧化时逐步释放的能量可驱动ADP磷酸化生成ATP（A对）。氧化磷酸化过程有两条途径：一条为NADH氧化呼吸途径；另一条为FADH₂氧化呼吸途径（D对）。一对电子经NADH氧化呼吸链传递，P/O比值约为2.5，生成2.5分子的ATP；经琥珀酸氧化呼吸链传递，P/O比值约为1.5，生成1.5分子的ATP（E错，为本题正确答案）。其中P/O比值是指氧化磷酸化过程中，每消耗1/2摩尔O₂所需磷酸的摩尔数，即所能合成ATP的摩尔数（C对）。